患者，男，55岁。3个月前因胸胁部撞伤后，而出现胁肋刺痛，痛有定处，入夜痛甚，舌质紫暗，脉沉涩。治疗应首选
A. 复元活血汤
B. 少腹逐瘀汤
C. 膈下逐瘀汤
D. 调营饮
E. 香附旋覆花汤

正确答案：A。复元活血汤

解析：题中患者以胁肋刺痛为主症，故诊断为胁痛，患者因胸胁部遭到撞伤，血溢脉外而成瘀血，瘀血痹阻胁络，故胁肋刺痛，痛有定处，血得阳始运，遇阴而凝，昼阳夜阴，故入夜尤甚，舌质紫暗，脉沉涩为瘀血内停阻络之象，故辨为瘀血内阻证，治宜祛瘀通络，方选血府逐瘀汤或复元活血汤（A对）。少腹逐瘀汤功能活血祛瘀，温经止痛，主治寒凝瘀血证，瘀血在少腹，题中瘀血在胸中胁肋部（B错）。膈下逐瘀汤功能活血祛瘀，行气止痛，主治瘀血阻滞膈下证，题中瘀血在胸中胁肋部（C错）。调营饮为鼓胀瘀结水留证的选方，功能活血化瘀，行气利水（D错）。香附旋覆花汤功能理气化饮和络，可用于治疗悬饮络气不和证（E错）。